在高效液相色谱的测定方法中，公式Cx（含量）=CRAX/AR适用的方法是
A. 内标法
B. 外标法
C. 主成分自身对照法
D. 标准加入法
E. 面积归一化法

正确答案：B。外标法

解析：本题考查高效液相色谱法。在高效液相色谱的测定方法中，公式Cx（含量）=CRAX/AR适用的方法是外标法（B对）。高效液相色谱法分为内标法和外标法，外标法是在空白溶剂中加入一定量的梯度标准物质制成对照品，并与未知样品平行处理检测，计算公式为：Cx（含量）=CRAX/AR。内标法是在分析样品的混合物中加入一定重量的纯物质作为内标，然后对含有内标的样品进行色谱分析，分别确定内标和待测组分的峰面积和相对校正因子，公式为：Cx（含量）=fAxCs/As。主成分自身对照法（C错）用于测定杂质含量。标准加入法（D错）用于气相色谱法。面积归一化法（E错）是计算时所用方法，计算各峰面积占总峰面积的百分率。